与二甲双胍合用能增加降血糖作用的非磺酰脲类胰岛素分泌促进剂是
A. 阿卡波糖
B. 西格列汀
C. 格列美脲
D. 瑞格列奈
E. 艾塞那肽

正确答案：D。瑞格列奈

解析：本题考查降糖药。与二甲双胍合用能增加降血糖作用的非磺酰脲类胰岛素分泌促进剂是瑞格列奈（D对）。阿卡波糖（A错）属于α-葡萄糖苷酶抑制剂，西格列汀（B错）属于内源性二肽基肽酶-4抑制剂，格列美脲（C错）属于磺酰脲类胰岛素分泌促进剂，艾塞那肽（E错）为胰高血糖素样肽1受体激动剂，可与二甲双胍联用控制血糖。